以下关于哪种疫苗不是我国卫生部规定的儿童计划免疫程序
A. 麻疹疫苗
B. 乙肝疫苗
C. 流感疫苗
D. 卡介苗
E. 百白破混合制剂

正确答案：C。流感疫苗

解析：本题考查我国儿童计划免疫的常用疫苗。我国卫生部规定的儿童计划免疫程序常用疫苗有：卡介苗（D对）、脊髓灰质炎疫苗、百白破疫苗（E对）、麻疹活疫苗（A对）和乙型肝炎疫苗（B对）。2007年国家扩大了计划免疫免费提供的疫苗种类，将在原有的“五苗七病”基础上增加到15种传染病。新增了甲型肝炎疫苗、乙脑疫苗、流脑多糖疫苗、风疹疫苗、腮腺炎疫苗、钩体病疫苗、流行性出血热疫苗和炭疽疫苗等，并不包括流感疫苗（C错，为本题的正确答案）。